维拉帕米的药理作用是
A. 促进Ca²⁺内流
B. 增加心肌收缩力
C. 直接抑制Na⁺内流
D. 降低窦房结和房室结的自律性
E. 升高血压

正确答案：D。降低窦房结和房室结的自律性

解析：本题考查维拉帕米的药理作用。维拉帕米为钙通道阻滞剂，通过抑制钙离子内流（AC错），延长窦房结和房室结不应期，减慢窦房结的自律性和房室结的传导（D对）。心肌细胞钙离子浓度减少，可降低心肌收缩力（B错），使血压下降（E错）。